患者，男，42岁。呃逆频作，声音洪亮有力，冲逆而出，口臭烦渴，多喜冷饮，脘腹满闷，大便秘结，舌苔黄燥，脉滑数。治疗应首选
A. 竹叶石膏汤
B. 橘皮竹茹汤
C. 凉膈散
D. 小承气汤
E. 泻心汤

正确答案：A。竹叶石膏汤

解析：题中患者以呃逆频作，声音洪亮有力，冲逆而出为主症，故诊断为呃逆。呃逆频作，声音洪亮有力，冲逆而出为胃肠积热，郁而化火，胃火上冲而致，热壅灼伤胃津，故见口臭烦渴，多喜冷饮，热邪内郁，肠间燥结，故脘腹满闷，大便秘结，舌苔黄燥，脉滑数为胃热内盛之象，故辨为胃火上逆证，治宜清胃泄热，降逆止呃，方选竹叶石膏汤（A对）。橘皮竹茹汤常合益胃汤治疗呃逆胃阴不足证，功能益气清热，和胃降逆（B错）。凉膈散用于治疗呃逆胃火上逆伴胸膈烦热，大便秘结者，功能泻火通便，清上泻下，非首选方（C错）。小承气汤用于治疗呃逆胃火上逆伴腑气不通，痞满便秘者，功能通腑泄热，轻下热结（D错）。泻心汤功能泻火消痞，主治邪热壅滞心下，气机痞塞证，不适用于胃火上逆证（E错）。